基因工程中的“转”指的是
A. 目的基因的选择
B. DNA转录为RNA
C. 逆转录RNA的合成
D. 目的DNA转入受体细胞
E. 目的基因导入质粒

正确答案：D。目的DNA转入受体细胞

解析：完整DNA克隆过程有①目的DNA的分离获取（分）；②载体的选择与准备（选）；③目的DNA与载体的连接（连）；④重组DNA 转入受体细胞（转）； ⑤重组体的筛选及鉴定（筛）五个步骤（D对ABCE错）。